产前诊断的疾病不包括
A. 唐氏综合征
B. 红绿色盲
C. 妊娠期高血压疾病
D. 苯丙酮尿症
E. 神经管缺陷

正确答案：C。妊娠期高血压疾病

解析：本题考查产前诊断的疾病。妊娠期高血压疾病（C错，为本题正确答案）是双胎妊娠最重要并发症，不属于产前诊断的疾病。产前诊断又称宫内诊断或出生前诊断，了解胎儿在宫内的发育状况，其常见疾病包括染色体异常的唐氏综合征（A对）；单基因病，如地中海贫血；性连锁遗传病，如红绿色盲（B对）、血友病等；遗传性代谢缺陷 病，如苯丙酮尿症（D对）、肝豆状核变性；先天性结构畸形如神经管缺陷（E对）等。